患者，男，53岁，季节性过敏性鼻炎病史5年，3天前，受凉后出现流涕、鼻塞、咳嗽，咳痰，低热，头痛，无胸闷、气短等其他不适，已在医院发热门诊完成了鼻拭子检查，排除了甲型流感和乙型流感，诊断为普通感冒。关于该患者咳嗽治疗的说法，错误的是
A. 若剧烈干咳伴胸痛，仅伴有少量白痰，可选用中枢性镇咳药
B. 单独使用抗组胺药物，对止咳无效
C. 若痰多而黏稠，应慎用镇咳药
D. 若使用含右美沙芬的药物，需告知服药期间应避免驾驶
E. 尽早使用抗菌药物治疗，能更有效地缓解咳嗽

正确答案：E。尽早使用抗菌药物治疗，能更有效地缓解咳嗽

解析：本题考查咳嗽治疗。抗菌药物对咳嗽治疗无效（E错，为本题正确答案）。咳嗽分为干咳或湿咳，对干咳可单用镇咳药；对痰液较多的湿咳则应以祛痰为主，不宜单纯使用镇咳药（C对），应与祛痰剂合用，以利于痰液排出和加强镇咳效果。对痰液特别多的湿性咳嗽，应该慎重使用镇咳药，以免痰液排出受阻而滞留于呼吸道内或加重感染。若剧烈干咳伴胸痛，仅伴有少量白痰，可选用中枢性镇咳药（A对）。要注意药物不良反应：如右美沙芬可引起嗜睡，需告知服药期间应避免驾驶（D对）。苯丙哌林对口腔黏膜有麻醉作用，产生麻木感觉，服药时需整片吞服，不可嚼碎。青光眼、心功能不全者慎用喷托维林；有报道喷托维林可造成儿童呼吸抑制，故5岁以下儿童不宜应用。单独使用抗组胺药物，对止咳无效（B对）。